血友病应选用的麻醉方法
A. 表面麻醉
B. 牙周膜注射法
C. 上牙槽后神经阻滞
D. 冷冻麻醉
E. 浸润麻醉

正确答案：B。牙周膜注射法

解析：本题考查牙髓治疗的疼痛控制。血友病应选用的麻醉方法为牙周膜注射法（B对）。牙周膜内注射用于其他麻醉法效果不佳的牙髓炎或根尖周炎患牙。某些特殊病例如血友病患者也常行牙周膜内注射。表面麻醉（A错）和冷冻麻醉（D错）不是牙髓治疗的疼痛控制方法。上牙槽后神经阻滞（C错）适用于上颌磨牙，但不适用于血友病的麻醉。局部浸润麻醉（E错）又称骨膜上浸润麻醉，是将麻醉剂注射到根尖部的骨膜上，通过麻醉剂的渗透作用使患牙在牙髓治疗时无痛。由于麻醉剂不能渗透密质骨，故骨膜上浸润麻醉仅适用于上下颌前牙、上颌前磨牙、上颌磨牙和乳牙。